下列哪个病证不宜用三棱针治疗
A. 丹毒
B. 高热
C. 头痛
D. 中暑昏迷
E. 虚证

正确答案：E。虚证

解析：三棱针法具有通经活络、开窍泄热、调和气血、消肿止痛等作用，其适应证为某些急症和慢性病如昏厥、高热（B对）、中暑（D对）、中风闭证、急性咽喉肿痛、目赤红肿、顽癣、疖痈初起、扭挫伤、疳积、痔疮、久痹、头痛（C对）、丹毒（A对）、指（趾）麻木等，但体弱、贫血、孕妇、产后等不宜使用，故虚症（E错，为本题正确答案）不宜用三棱针治疗。